胆总管、胰管共同开口于
A. 十二指肠球部
B. 十二指肠升部
C. 十二指肠降部
D. 十二指肠水平部
E. 十二指肠空肠曲

正确答案：C。十二指肠降部

解析：肝总管、胰管汇合成肝胰壶腹，开口于十二指肠降部(C对)的十二指肠大乳头。